影响毒物对机体毒作用的因素，不包括
A. 毒物的浓度与作用时间
B. 毒物本身的理化特性
C. 毒物间的联合作用
D. 人体遗传特性
E. 性格与婚姻状态

正确答案：E。性格与婚姻状态

解析：本题考查影响毒物对机体毒作用的因素。影响毒物对机体毒作用的因素主要包括以下几类：①毒物的化学结构，物质的化学结构决定其理化性质（B对），而物质的理化性质、化学活性又与其生物学活性和生物学作用密切相关，并在某种程度上决定其毒性；②剂量、浓度和接触时间（A对）；③联合作用（C对）；④个体易感性，研究表明产生个体易感性差异的决定因素是遗传特征（D对）。性格与婚姻状态（E错，为本题正确答案）并不是影响毒物对机体毒作用的因素。